小儿尿路感染急性期，肝胆郁热证的治法是
A. 滋阴补肾
B. 健脾益气
C. 活血化瘀
D. 泻火解毒，清利肝胆
E. 健脾补肾，佐以渗湿

正确答案：D。泻火解毒，清利肝胆

解析：小儿尿路感染急性期，肝胆郁热证是由于湿热邪毒扰及肝胆，疏泄不利所致，治疗时应泻火解毒，清利肝胆（D对）。